具C₁₅H₂₄通式的萜类成分属于
A. 二萜类
B. 三萜类
C. 倍半萜类
D. 单萜类
E. 四萜类

正确答案：C。倍半萜类

解析：本题考查的是萜的分类。具C₁₅H₂₄通式的萜类成分属于倍半萜（C对）。萜类化合物是一类由甲戊二羟酸衍生而成，基本碳架多具有2个或2个以上异戊二烯单位（C5单位）结构特征的不同饱和程度的衍生物。按照分子中异戊二烯单位的数目可将萜类化合物分为单萜、倍半萜、二萜、二倍半萜、三萜、四萜及多萜。1.单萜（D错）：单萜是指基本碳架由2分子异戊二烯单位构成，含有10个碳原子的萜烯及其衍生物。2.环烯醚萜类：环烯醚萜类为臭蚁二醛的缩醛衍生物，属单萜类化合物。3.倍半萜：倍半萜类是由3个异戊二烯单位构成的天然萜类化合物。4.二萜（A错）：是指骨架由4个异戊二烯单位构成，含20个碳原子的一类萜类衍生物。5.三萜（B错）：基本骨架由6个异戊二烯单位组成。6.四萜（E错）：基本骨架由6个异戊二烯单位组成，大多以植物胡萝卜素形式存在。